蔬菜在烹调时损失最多的营养素是
A. 蛋白质
B. 脂肪
C. 维生素C
D. 维生素E
E. 维生素A

正确答案：C。维生素C

解析：本题考查蔬菜在烹调时损失最多的营养素。蔬菜在烹调时损失最多的营养素是维生素C（C对ABDE错）。